符合《互联网药品信息服务管理办法》规定的表述有
A. 互联网药品信息服务分为经营性和非经营性两类
B. 提供互联网药品信息服务的网站，应当在其网站主页显位置标注《互联网药品信息服务资格证书》的证书编号
C. 提供互联网药品信息服务的网站均可自行发布药品广告
D. 提供互联网药品信息服务网站所登载的药品信息必须科学、准确
E. 提供互联网药品信息服务的网站可发布医疗机构制剂的产品信息

正确答案：A、B、D。互联网药品信息服务分为经营性和非经营性两类；提供互联网药品信息服务的网站，应当在其网站主页显位置标注《互联网药品信息服务资格证书》的证书编号；提供互联网药品信息服务网站所登载的药品信息必须科学、准确

解析：本题考查互联网药品信息服务的管理。符合《互联网药品信息服务管理办法》规定的表述有互联网药品信息服务分为经营性和非经营性两类（A对）；提供互联网药品信息服务的网站，应当在其网站主页显位置标注《互联网药品信息服务资格证书》的证书编号（B对）；提供互联网药品信息服务网站所登载的药品信息必须科学、准确（D对）。互联网药品信息服务的分类及分类要点：互联网药品信息服务分为经营性和非经营性两类。经营性互联网药品信息服务是指通过互联网向上网用户有偿提供药品信息等服务的活动。非经营性互联网药品信息服务是指通过互联网向上网用户无偿提供公开的、共享性药品信息等服务的活动。互联网药品信息的发布：提供互联网药品信息服务的网站，应当在其网站主页显著位置标注《互联网药品信息服务资格证书》的证书编号。提供互联网药品信息服务网站所登载的药品信息必须科学、准确，必须符合国家的法律、法规和国家有关药品、医疗器械管理的相关规定。提供互联网药品信息服务的网站不得发布麻醉药品、精神药品、医疗用毒性药品、放射性药品、戒毒药品和医疗机构制剂的产品信息（E错）。提供互联网药品信息服务的网站发布的药品（含医疗器械）广告，必须经过药品监督管理部门审查批准（C错）。提供互联网药品信息服务的网站发布的药品（含医疗器械）广告要注明广告审查批准文号。